以下关于卫生法的分类，正确的是
A. 公共卫生法
B. 医疗法和药事法
C. 中医药法
D. 医疗保障法
E. 以上均正确

正确答案：E。以上均正确